女，20岁。1个月前因工作差错被领导批评后出现心情烦躁，经常哭泣，认为自己没有能力，什么事都干不好，周围人的眼神不怀好意，看她笑话。失眠，早醒。近一周病情加重，觉得生不如死，在家中拒食等死。入院治疗1个月后，情绪好转，在病室中常哼哼小曲，好管闲事，看不起其他病人，喜欢指责他人，精力旺盛，睡眠减少。该患者当前最可能的情况是
A. 躁狂发作
B. 病情加重
C. 环性人格
D. 病情复燃
E. 病情缓解

正确答案：A。躁狂发作

解析：入院治疗1个月后，情绪好转，在病室中常哼哼小曲（情感高涨为主要表现），精力旺盛、好管闲事（活动增多），看不起其他病人（自我评价高，夸大观念），睡眠减少，故最可能为躁狂发作（A对）。